遴选非处方药时首先考虑的是
A. 使用安全
B. 剂型多样
C. 质量可控
D. 说明书详细
E. 价格低廉

正确答案：A。使用安全